气管上端于第6颈椎处起于喉，向下到胸骨角平面分为左、右主支气管。关于气管软骨环的叙述，下列哪项是正确的
A. 数目不少于20个
B. 气管的后壁缺少软骨
C. 缺少软骨的部分由气管平滑肌封闭
D. 气管切开术通常在第6气管软骨环以下进行
E. 各气管软骨环之间没有平滑肌

正确答案：B。气管的后壁缺少软骨

解析：气管软骨有14-17个（A错）。气管的后壁缺少软骨（B对）。缺少软骨的部分由弹性纤维和平滑肌封闭（C错）。气管切开术常在第3-5气管软骨环处施行（D错）。